以聚乙二醇（4000，6000）为基质的滴丸制备时，冷凝液宜选用
A. 肥皂醑
B. 甘油
C. 植物油
D. 稀硫酸
E. 不同浓度的乙醇

正确答案：C。植物油

解析：本题考查的是丸剂的冷凝液。以聚乙二醇（4000，6000）为基质的滴丸制备时，冷凝液宜选用植物油（C对）。滴丸水溶性冷凝液：水及不同浓度乙醇、稀酸溶液等，适于非水溶性基质滴丸；非水溶性冷凝液：液状石蜡、二甲基硅油、植物油或其混合物等，适于水溶性基质滴丸。滴丸制备的基质为聚乙二醇（4000，6000）是水溶性基质，应选择植物油为冷凝液。增塑剂：能使制得的膜柔软并具有一定的抗拉强度。常用的有甘油（B错）、乙二醇、山梨醇等。流浸膏剂与浸膏剂有以水为溶剂制备而成和以乙醇为溶剂制备而成之分，其中大多以不同浓度的乙醇为溶剂，以水为溶剂者较少。以水为溶剂的流浸膏剂中可酌加20%～25%的乙醇（E错）为防腐剂。